目前慢性阻塞性肺疾病治疗的最重要药物是
A. 支气管舒张剂
B. 吸入糖皮质激素
C. 抗氧化剂
D. 祛痰药
E. 粘液生成抑制剂

正确答案：A。支气管舒张剂

解析：慢性阻塞性肺疾病的特征性表现是持续不可逆的气道阻塞和气流受限导致肺通气功能障碍，但并不是完全不可逆，有时气道阻塞很小程度的减轻就可以使患者的气短症状明显缓解，所以支气管舒张剂（A对）是现有控制症状的主要措施（P25）。吸入糖皮质激素（B错）对慢性阻塞性肺疾病合并哮喘的患者有肯定疗效，但对其他慢性阻塞性肺疾病患者疗效不一致（P25-P26）。慢性阻塞性肺疾病患者的氧化应激增加，抗氧化剂（C错）可降低疾病加重频率，但不是最重要的治疗药物（十四版实用内科学P1699）。祛痰药（D错）对痰不易咳出者可应用，有利于气道引流通畅，改善通气，但疗效不确切（P26）。粘液生成抑制剂（E错）主要用来抑制粘液生成，来治疗COPD及哮喘。